下面哪个因素会使人群易感性降低
A. 计划免疫
B. 新生儿增加
C. 易感人口迁入
D. 免疫人口免疫力自然消退
E. 免疫人口死亡

正确答案：A。计划免疫